以下关于中线致死性肉芽肿的叙述，错误的是
A. 是一种恶性淋巴瘤
B. 症状以溃疡和坏死为主，常多次病检而仅报告为慢性炎症
C. 多发生在口腔及面部中线部位
D. 多伴有特殊臭味
E. 主要表现为炎性溃疡、糜烂、坏死，但无骨质破坏

正确答案：E。主要表现为炎性溃疡、糜烂、坏死，但无骨质破坏

解析：NK/T淋巴瘤多发生在口腔及面部中线部位，口腔中初发者多在腭咽部中线。症状以溃疡和坏死为主，常多次病检而仅报告为慢性炎症，故曾有“中线坏死性肉芽肿”之称。破坏腭骨后，可造成口鼻穿孔，形成口鼻瘘。常伴有特殊臭味，并可伴全身高热不适等症状。首发症状也可出现在鼻腔和鼻窦，耳鼻喉科特称为鼻腔鼻窦淋巴瘘。掌握“恶性淋巴瘤”知识点。